我国的大气卫生标准基本上属于
A. 第一级
B. 第二级
C. 第三级
D. 介于第一级第二级之间
E. 介于第二级和第三级之间

正确答案：A。第一级

解析：本题考查我国的大气卫生标准。我国的大气卫生标准基本上属于第一级（A对BCDE错）。我国大气卫生标准是由国家环境保护总局制定的，第一级是最严格的标准。